女，30岁。呕吐，腹胀5天。神志不清，胡言乱语1天。平素体健。查体：T36.5℃，P90次/分，R18次/分，BP120/80mmHg，巩膜明显黄染，心肺未见明显异常。腹软，无压痛。肝浊音界缩小。实验室检查：血ALT520U/L，TBil215μmol/L，DBil138μmol/L。其典型的肝脏病理改变主要是
A. 汇管区纤维化
B. 多个小叶或大块肝细胞坏死
C. 淤血性改变
D. 汇管区中性粒细胞浸润
E. 肝细胞脂肪变性

正确答案：B。多个小叶或大块肝细胞坏死

解析：患者青年女性，呕吐，腹胀5天。神志不清，胡言乱语1天。巩膜明显黄染，肝浊音界缩小。实验室检查：血ALT520U/L（正常值为0～40U/L，升高提示肝功能受损），TBil215μmol/L（正常值3.4～17.1μmol/L，升高提示肝功能受损），DBil138μmol/L（正常值0～6.8μmol/L，升高提示肝功能受损）。诊断为急性重症肝炎，发病初期肝脏无明显缩小，约一周后肝细胞大块坏死或亚大块坏死或桥接坏死（B对），坏死肝细胞占2/3以上，周围有中性粒细胞浸润，不是主要特征（D错），无纤维组织增生（A错），亦无明显的肝细胞再生。淤血性改变和肝细胞脂肪变性见于右心衰（CE错）。